历代本草著作中记载藏药最多的是
A. 本草经集注
B. 新修本草
C. 证类本草
D. 本草纲目
E. 晶珠本草

正确答案：E。晶珠本草